在八脉交会穴中，通督脉的是
A. 后溪
B. 公孙
C. 太渊
D. 列缺
E. 内关

正确答案：A。后溪

解析：八脉交会穴歌诀：公孙冲脉胃心胸，内关阴维下总同。临泣胆经连带脉，阳维目锐外关逢。后溪督脉内眦颈，申脉阳跷络亦通。列缺任脉行肺系，阴跷照海膈喉咙。可知，后溪通督脉（A对）。公孙通冲脉（B错）；列缺通任脉（D错）；内关通阴维脉（E错）；申脉通阳跷脉；外关通阳维脉；照海通阴跷；太渊（C错）为肺之输穴、原穴、八会穴之脉会。